男，46岁。饮酒史26年。因被家人禁止饮酒，次日出现不识家人，随地便溺，双手粗大震颤，下肢站立不稳，无法行走。检查时将医生认作科学家，把病室当成派出所，感到自己被抓进来做人体试验，不时用手拍打墙面，声称看见有许多臭虫蟑螂在爬。神色惊恐，大量出汗。首选药物是
A. 地西泮
B. 氯丙嗪
C. 氯氮平
D. 氯米帕明
E. 盐酸苯海素

正确答案：A。地西泮

解析：该病患饮酒26年（长期饮酒史），因被家人禁止饮酒次日出现不识家人，双手粗大震颤，出现震颤谵妄。看见有许多臭虫蟑螂在爬（知觉异常），神色惊恐，大量出汗。故诊断为酒精戒断，应首选苯二氮䓬类药物镇静治疗，地西泮（A对）每次10mg，2～3次/日，如果口服困难应选择注射途径。本例患者出现戒断性幻觉，可选用氯丙嗪（第一代抗精神病药物）和氯氮平（第二代抗精神病药物）控制精神症状，但不作为首选（BC错）。氯米帕明为抗抑郁药物，主要用于抑郁症（D错）。